依照《母婴保健法》规定施行终止妊娠或者结扎手术，应当经
A. 近亲属同意，并签署意见
B. 监护人同意，并签署意见
C. 本人同意，并签署意见
D. 亲属同意，并签署意见
E. 单位负责人同意，并签署意见

正确答案：C。本人同意，并签署意见